初孕妇，26岁。妊娠35周，自觉头痛、视物模糊2周，晨起突然出现持续性腹痛且逐渐加重。腹部检查：子宫板状硬。该患者最可能的诊断是
A. 先兆早产
B. 胎盘早剥
C. 急性阑尾炎
D. 前置胎盘
E. 先兆子宫破裂

正确答案：B。胎盘早剥

解析：青年初孕妇，妊娠35周，自觉头痛视物模糊2周，晨起突然出现持续性腹痛且逐渐加重，子宫板状硬（胎盘早剥，持续性腹痛较Ⅱ度加重），最可能的诊断是胎盘早剥（B对）。先兆早产（A错）指妊娠满28周，不足37周者，出现规律或不规律宫缩，宫颈管进行性缩短。大部分急性阑尾炎（P98）（C错）表现为转移性右下腹痛，伴恶心、呕吐、发热，及右下腹压痛、反跳痛和腹肌紧张。前置胎盘（P127）（D错）表现为妊娠晚期或临产时，发生无诱因、无痛性反复阴道流血。先兆子宫破裂（P218）（E错）常见于产程长、有梗阻性难产的产妇，表现为产妇烦躁不安、呼吸、心率加快，下腹剧痛难忍，出现少量阴道流血。